巅顶部位头痛属于
A. 太阳头痛
B. 阳明头痛
C. 少阳头痛
D. 厥阴头痛
E. 少阴头痛

正确答案：D。厥阴头痛

解析：厥阴脉会于巅顶，巅顶部头痛，亦为厥阴头痛之证候特色（D对）。太阳经头痛部位以后枕部疼痛为主（A错）。 阳明经头痛部位以前额、面颊、眉棱骨常见（B错）。少阳经头痛部位以头侧为主（C错）。 少阴头痛以头痛连齿多见（E错）。